根据《医疗机构制剂配制质量管理规范（试行）》，制剂出现质量问题需要收回时，制剂收回记录的内容不包括
A. 制剂名称
B. 制剂工艺
C. 制剂批号
D. 收回部门
E. 处理意见

正确答案：B。制剂工艺

解析：本题考查制剂收回记录。制剂在使用过程中出现质量问题时，制剂质量管理组织应及时进行处理，出现质量问题的制剂应立即收回，并填写收回记录。收回记录应包括：制剂名称、批号、数量、收回部门、收回原因、处理意见及日期等。不包括制剂工艺（B错，为本题正确答案）。